医疗侵权赔偿责任中，医疗过错的认定标准是
A. 未尽到分级诊疗的义务
B. 未尽到先行垫付的义务
C. 未尽到健康教育的义务
D. 未尽到主动协商的义务
E. 未尽到与当时医疗水平相适应的义务

正确答案：E。未尽到与当时医疗水平相适应的义务

解析：根据《侵权责任法》第七章医疗损害责任第五十七条：医务人员在诊疗活动中未尽到与当时医疗水平相应的诊疗义务，造成患者损害的，医疗机构应当承担赔偿责任。医疗侵权赔偿责任中，医疗过错的认定标准是未尽到与当时医疗水平相适应的义务（E对）。